活体内异常物体沿血流运行阻塞相应的血管的过程叫
A. 梗塞
B. 栓塞
C. 梗死
D. 栓子
E. 血栓形成

正确答案：B。栓塞

解析：活体内异常物体沿血流运行阻塞相应血管的过程叫栓塞（B对）。栓子（D错）是指阻塞血管的异常物质。梗塞（A错）是指器官或局部组织由于血管阻塞导致血流停止的现象，而由于血流停止导致缺氧而发生的坏死称为梗死（P57）（C错）。血栓形成（P48）（E错）是指在活体的心脏和血管内，血液发生凝固或血液中某些有形成分凝集形成固体质块的过程。